《处方管理办法（试行）》规定，保存期限的处方销毁须经
A. 医疗、预防、保健机构或药品零售企业专管领导批准、登记备案
B. 县以上卫生行政部门批准、登记备案
C. 县以上（食品）药品监督管理部门批准、登记备案
D. 县以上监督管理部门批准、登记备案
E. 医疗、预防、保健机构或药品零售企业的主管部门批准、登记零售

正确答案：A。医疗、预防、保健机构或药品零售企业专管领导批准、登记备案

解析：本题考查药品使用管理。保存期限的处方销毁须经医疗、预防、保健机构或药品零售企业专管领导批准、登记备案（A对）。处方保存期满后，经医疗机构主要负责人批准、登记备案，方可销毁，不是经行政部门、药品监督管理部门批准。